过敏反应属于
A. 生物性致病因素
B. 先天性致病因索
C. 理化性致病因素
D. 免疫性致病因素
E. 遗传性致病因素

正确答案：D。免疫性致病因素

解析：免疫性致病因素（D对）是指免疫反应过强、免疫缺陷或自身免疫反应等，可导致过敏反应。